不是肉毒梭菌特点的是
A. 芽胞位于菌体次极端，菌体呈网球拍状
B. 严格厌氧
C. 致病物质主要是肉毒毒素
D. 引起疾病主要是化脓性感染
E. 肉毒毒素作用机制是阻止神经组织释放乙酰胆碱

正确答案：D。引起疾病主要是化脓性感染